治疗肺炎支原体肺炎宜选用
A. 青霉素
B. 头孢呋肟
C. 丁胺卡那霉素
D. 红霉素
E. 链霉素

正确答案：D。红霉素

解析：治疗肺炎支原体肺炎宜选用红霉素（D对）。青霉素（A错）、头孢呋肟（B错）、丁胺卡那霉素（C错）、链霉素（E错）对支原体不敏感，不宜用于治疗肺炎支原体肺炎。